男19岁，头痛恶心呕吐，双下肢痉挛半小时，半小时前烈日下负重跑5km，查体：T：38.6℃，P119/分，BP105/68mmHg，神志清楚，颈软，全身皮肤潮湿，四肢肌张力高，最可能是
A. 热射病
B. 横纹肌溶解
C. 热痉挛
D. 蛛网膜下腔出血
E. 热衰竭

正确答案：C。热痉挛

解析：患者男19岁，头痛恶心呕吐，双下肢痉挛半小时，半小时前烈日下负重跑5km（患者存在剧烈活动表现），查体：T：38.6℃，P119/分，BP105/68mmHg，神志清楚，颈软，全身皮肤潮湿，四肢肌张力高（热痉挛表现，患者处于热射病早期），结合患者的综合表现，最可能诊断为热痉挛（C对）。热射病、横纹肌溶解、蛛网膜下腔出血和热衰竭不会出现腹壁肌群痛性痉挛等表现（ABDE错）。